渗出性结核性腹膜炎的最佳的强化治疗方案是
A. 异烟肼、利福平、吡嗪酰胺、链霉素
B. 异烟肼、链霉素、对氨基水杨酸
C. 异烟肼、链霉素、对氨基水杨酸、糖皮质激素
D. 异烟肼、链霉素、对氨基水杨酸、加手术腹腔引流
E. 异烟肼、利福平

正确答案：A。异烟肼、利福平、吡嗪酰胺、链霉素

解析：渗出性结核性腹膜炎治疗的关键是及早给予合理、足够疗程的抗结核化学药物治疗（P372），强化治疗方案参考肺结核，多采用四种化疗药物联合化疗。异烟肼是单一抗结核药物中杀菌力最强者，对巨噬细胞内外的结核分枝杆菌均具有杀菌作用，是各种治疗方案的必备药物；利福平对巨噬细胞内外的结核分枝杆菌均有快速杀菌作用，特别是对C菌群（处于半静止状态）有独特的杀菌作用；吡嗪酰胺对巨噬细胞内酸性环境中的B菌群有独特的杀菌作用；链霉素对巨噬细胞外碱性环境中的A菌群有杀灭作用。异烟肼、利福平、吡嗪酰胺、链霉素（A对）均为杀菌药，且兼顾杀灭巨噬细胞内外的结核杆菌，为最佳的强化治疗方案。对氨基水杨酸（B错）为抑菌剂，为治疗结核的二线药物。糖皮质激素（C错）可使结核感染扩散，一般不使用。结核性腹膜炎首选药物治疗，手术治疗（D错）的适应证为：①并发完全或不完全肠梗阻；②急性肠穿孔；③肠瘘经抗结核药物治疗无效时；④诊断困难，与急腹症无法鉴别时（P372）。异烟肼+利福平（E错）为两种杀菌剂联合，治疗效果不佳。